一位农村来就诊的患者，对于各种诊疗程序都不了解。医院中的护士耐心的指导他，帮助其顺利就医。体现了的医患关系的原则是
A. 平等原则
B. 尊重原则
C. 有利原则
D. 不伤害原则
E. 公正原则

正确答案：B。尊重原则

解析：尊重原则对医务人员的要求一是尊重患者的生命、人格尊严，呵护患者的隐私。二是处理好患者自主与医方做主的关系。医生要尊重患者的知情同意和知情选择的权利，对于缺乏或丧失自主能力的患者，应尊重其家属或监护人的此项权利。但当患者病情危急需要立即进行处置和抢救，家属不在场，来不及获取患者家属知情同意的时候，医务人员出于对患者责任和利益的考虑，可以行使特殊干涉权，做出对患者有利的决定。三是履行帮助、劝导、限制患者及其亲属选择的责任。医务人员首先要帮助患者，为其提供正确、适量的信息并帮助患者理解，以利于患者的选择。其次，劝导患者。如果患者的选择与医务人员的期望不同，医务人员应劝导患者，而不要采取听之任之、出了问题患者责任自负的态度。如果劝导后患者及家属仍坚持己见，则应尊重他们的自主权。最后，如果患者的选择与他人、社会的利益发生矛盾，有可能损害他人和社会利益时，医务人员应首先协助患者进行调整，以履行对他人和社会的责任，并使对患者的损害降到最低。一旦患者的选择对他人的生命和健康构成威胁或者对社会利益造成危害，医务人员适当限制患者的选择是符合道德的。而对于家属做出的对患者不利的选择，医务人员也有责任予以干涉。题目中的情景体现了第三条，故选B。